胃蛋白酶原由
A. 壁细胞分泌
B. 主细胞分泌
C. S细胞分泌
D. I细胞分泌
E. G细胞分泌

正确答案：B。主细胞分泌